通过抑制血管紧张素转化酶发挥药理作用的药物是
A. 依那普利
B. 阿司匹林
C. 厄贝沙坦
D. 硝苯地平
E. 硝酸甘油

正确答案：A。依那普利

解析：本题考查属于血管紧张素转换酶（ACE）抑制剂的药物。依那普利（A对）属于双羧基血管紧张素转换酶（ACE）抑制剂，通过抑制血管紧张素转化酶发挥药理作用。阿司匹林（B错）为为水杨酸的衍生物，属于环氧化酶（COX）的不可逆抑制剂。厄贝沙坦（C错）是血管紧张素Ⅱ受体拮抗剂。硝苯地平（D错）为钙通道阻滞剂。硝酸甘油（E错）为血管扩张药，用于治疗冠状动脉狭窄引起的心绞痛。